女，28岁。平时性格拘谨认真，3个月前开始见到刀具就担心会持刀伤害家人和自己，为此不敢去厨房做家务。明知这种想法不合理，但无法控制自己，深感苦恼。最可能诊断是
A. 恐惧症
B. 癔症
C. 强迫症
D. 精神障碍
E. 心理疾病

正确答案：C。强迫症

解析：该病例患者为青少年女性（20～24岁的女性好发），明知见到刀具会伤害家人和自己是不合理的想法，但无法控制自己，深感苦恼，为强迫思维的表现，故最可能的诊断是强迫症（C对）。恐惧症和强迫症均有焦虑表现，恐惧症是一种以过分和不合理地惧怕外界某种客观事物（黑暗、雷电）或情境（公众场合发表演讲）为主要表现，患者明知这种恐惧反应是过分的或不合理的，但仍反复出现，无强迫观念和强迫行为，故不考虑（A错）。